小血管损伤后止血栓正确定位于损伤部位是由于血小板的哪种生理特性
A. 吸附
B. 黏附
C. 聚集
D. 收缩
E. 释放

正确答案：B。黏附